毛果芸香碱对以下哪种腺体无作用
A. 泪腺
B. 胃腺
C. 胰腺
D. 小肠腺
E. 胸腺

正确答案：E。胸腺

解析：毛果芸香碱对腺体的作用：较大剂量毛果芸香碱除可使汗腺和唾液的分泌明显增加外，也可使泪腺、胃腺、胰腺、小肠腺体和呼吸道黏膜分泌增加。掌握“毛果芸香碱”知识点。